下列各项中，不引起心律失常的药物是
A. 蟾蜍
B. 黄芪
C. 洋地黄
D. 夹竹桃
E. 乌头

正确答案：B。黄芪

解析：黄芪具有扩张的冠状动脉、改善心肌缺血以及对抗心律失常、提高免疫力等一系列功效（B对）；蟾蜍皮肤上的疙瘩里含有毒液（蟾酥），中毒后可引起心律失常，甚或惊厥、呼吸衰竭（A错）；中毒量的洋地黄会严重抑制Na⁺-K⁺-ATP酶的活性，不仅能增加钙离子的内流，还会减少钠离子的外流和钾离子的内流，导致细胞内钠离子、钙离子浓度增加，钾离子浓度将低，使细胞内严重失钾，心肌细胞和浦肯野纤维的自律性增高、传导减慢，从而形成各种心律失常（C错）；夹竹桃是一种有毒植物，含有各种毒素，其中毒症状一般表现为胃肠道方面，可能会出现食欲下降，恶心呕吐，腹痛腹泻，头晕头疼，倦怠乏力，发热，指尖或口唇发麻等，严重时表现为洋地黄中毒症状，如出现心律失常，传导阻滞，心动过缓，房颤的表现（D错）；乌头中含有的乌头碱对迷走神经有强烈的兴奋作用，对中枢神经系统有先兴奋后抑制的作用，更有兴奋和麻痹感觉及运动神经末梢的作用，能加速心率及增强心肌收缩力，并能直接作用于心肌，产生高频异位节律而引起窦性、房性、室性心律失常，最后造成心室颤动与停搏（E错）。